旋覆花的功效是
A. 降气止呕
B. 泻肺平喘
C. 消痰软坚
D. 祛风止痉
E. 燥湿化痰

正确答案：A。降气止呕

解析：本题考查的是旋覆花的功效。旋覆花的功效是降气止呕（A对）。旋覆花：【功效】消痰行水，降气止呕。葶苈子：【功效】泻肺平喘（B错），利水消肿。海藻：【功效】消痰软坚（C错），利水消肿。天南星：【功效】燥湿化痰（E错），祛风止痉（D错），散结消肿。